经医师资格考试或助理医师考试，取得医师或助理医师资格，可以申请注册，受理机构是
A. 县级以上卫生行政部门
B. 县级以上人民政府
C. 省(自治区)级卫生行政部门
D. 国务院卫生行政部门
E. 县级以上卫生防疫机构

正确答案：A。县级以上卫生行政部门

解析：《执业医师法》规定，取得医师资格的，可以向所在地县级以上人民政府卫生行政部门（A对）申请注册。